《中国药典》中应进行折光率测定的药物有
A. 维生素B1
B. 维生素C
C. 维生素E
D. 维生素K1
E. 葡萄糖

正确答案：C、D。维生素E；维生素K1